根管再治疗的步骤包括
A. 开髓和髓室预备
B. 疏通和根管再预备
C. 根管消毒
D. 根管再充填
E. 以上均包括

正确答案：E。以上均包括

解析：本题考查根管再治疗。根管再治疗的方法包括建立进入髓室的通道（开髓）、进入根管的通道（髓室预备）（A对）、进入根管根尖部的通道（疏通根管），根管再预备（B对）、根管消毒（C对）以及根管再充填（D对）。综上所述，以上均对（E对，为本题正确答案）。